关于真菌性败血症的描述中下列哪项不正确
A. 主要致病菌是白色念珠菌
B. 多发生于用广谱抗生素治疗的基础上
C. 突然发生寒战、高热
D. 应用广谱抗生素早期即可发生此症
E. 多数病人有类白血病反应

正确答案：D。应用广谱抗生素早期即可发生此症

解析：真菌性败血症的致病菌主要有白色念球菌，曲霉菌等，多数患者在之前已经有抗菌药物治疗史，临床表现为骤起寒战，继以高热可达40～41℃，其实验室检查白细胞计数明显增高，一般常可达（20～30）×109/L以上，或降低、左移、幼稚型增多，出现毒性颗粒等类似白血病样表现。掌握“外科感染”知识点。